25岁就诊患者，口腔卫生情况不佳，左下第一恒磨牙患者有牙髓-牙周联合病变，疼痛剧烈，但患牙无松动。为了消除病痛，恢复健康首先采取的措施
A. 早期充填
B. 开髓引流，阻止炎症扩展
C. 消炎止痛
D. 促进牙周软组织健康
E. 使用氟化物

正确答案：B。开髓引流，阻止炎症扩展

解析：本题考查应急处理-开髓引流。患者发生牙髓-牙周联合病变，疼痛剧烈，拔除牙髓引流炎症渗出物后，可缓解髓腔高压，减轻疼痛，阻止炎症扩展（B对）。早期充填（A错）多用于龋病与牙本质敏感，对于牙髓病和根尖周病效果不佳。患牙牙髓病变，消炎止痛（C错）只是暂时性缓解疼痛，不能彻底清除感染物质。患牙疼痛剧烈，应先缓解疼痛，而促进牙周软组织健康（D错）治标不治本。氟化物（E错）多用于防龋，而患牙已发生牙髓炎，使用氟化物已无意义。